在经皮给药制剂中，可用作控释膜材料的是
A. 聚苯乙烯
B. 微晶纤维素
C. 乙烯-醋酸乙烯共聚物
D. 硅橡胶
E. 低取代羟丙基纤维素

正确答案：C。乙烯-醋酸乙烯共聚物

解析：本题考查经皮给药制剂的处方材料。乙烯-醋酸乙烯共聚物（C对）可作为控释膜材料。聚苯乙烯（A错）常用作背衬层材料；微晶纤维素（B错）是片剂常用填充剂；硅橡胶（D错）为常用囊材；低取代羟丙基纤维素（L-HPC）（E错）是片剂中常用崩解剂。